24岁男性，农民。因畏寒发热起病，伴全身肌肉酸痛，头痛4天，于8月10日入院。入院1天发现皮肤黄染，尿量减少，尿色深黄，查体：结膜充血，巩膜及皮肤中度黄染，皮肤有出血点，浅表淋巴结肿大，肝肋下lcm，压痛（+），脾（-），实验室检查WBC15.4×l0⁹/L，N80%，L20%，尿检：尿蛋白（+），颗粒管型，WBC8～15/HP，RBC20～30/HP，BUN24mmol/L，凝集溶解试验阳性。哪项检查最有诊断意义
A. 血常规
B. 尿常规
C. X线
D. 凝集溶解试验
E. 肾功能

正确答案：D。凝集溶解试验

解析：患者起病出现早期中毒综合征，有“三症状”，即畏寒发热、肌肉酸痛、全身乏力，眼结膜充血、腓肠肌压痛、淋巴结肿大、肝大，凝集溶解试验阳性，应诊断为钩端螺旋体病。特异性血清学检查或病原学检查阳性，可明确诊断钩端螺旋体病。故凝集溶解试验（D对）最有诊断意义。血常规（A错）为一般检查，特异性不如凝集溶剂试验。尿常规（B错）、X线（C错）、肾功（E错）很少用于钩体病检查。